丧失体液达体重的多少时，会出现血容量不足的症状
A. 2%～3%
B. 0.03
C. 0.05
D. 0.09
E. 0.1

正确答案：C。0.05

解析：本题考查等渗性脱水的临床表现。当病人出现血容量不足的症状时，说明在短期内体液丧失至少已达体重的5%（C对ABDE错）；当体液继续丧失达体重的6％～7％时，则有更严重的休克表现休克的微循环障碍。